心绞痛发作时，应首选的药物是
A. 普萘洛尔
B. 硝酸甘油
C. 硝苯地平
D. 异搏定
E. 哌替啶

正确答案：B。硝酸甘油

解析：心绞痛通常是在冠状动脉固定性严重狭窄基础上，由于心肌负荷的增加引起心肌急剧的、暂时的缺血缺氧的临床综合征。由于硝酸甘油（B对）起效较快，故心绞痛发作时应首选的药物是硝酸甘油。普萘洛尔（A错）、硝苯地平（C错）、异搏定（维拉帕米）（D错）主要用于心绞痛缓解期的治疗。哌替啶（E错）可解除疼痛，主要用于治疗心肌梗死。